下列哪项不是浅Ⅱ度烧伤的特点
A. 有水疱
B. 创底肿胀发红、剧痛
C. 可见网状栓塞血管
D. 约2周愈合
E. 愈合不留瘢痕

正确答案：C。可见网状栓塞血管

解析：本题考查浅Ⅱ度烧伤的特点。可见网状栓塞血管是（C错，为本题正确答案）Ⅲ度烧伤的特点。浅Ⅱ度烧伤的特点：有水疱（A对），创底肿胀发红、剧痛（B对），约2周愈合（D对），愈合不留瘢痕（E对）。